新斯的明的药理作用是
A. 激活胆碱酯酶
B. 激活M受体
C. 抑制胆碱酯酶
D. 阻断M受体
E. 激动N受体

正确答案：C。抑制胆碱酯酶

解析：新斯的明与胆碱酯酶结合，与乙酰胆碱结构相似发挥竞争性抑制作用，即抑制胆碱酯酶（C对A错），使内源性乙酰胆碱体内堆积表现乙酰胆碱作用发挥完全拟胆碱作用即兴奋M、N胆碱受体（BDE错），其对骨骼肌及胃肠平滑肌兴奋作用较强，临床用于治疗重症肌无力、减轻由手术或其他原因引起的腹胀气和尿潴留。